某班十儿名学生突然出现脸似红布、胡言乱语、小腿抖等症状，患儿被送到医院。经详细体格检查，排除了传染病、食物中毒、过敏等疾病，这些孩子可能患有下列哪种疾病
A. 强迫行为
B. 恐惧
C. 心境障碍
D. 雷特综合征
E. 儿童癔症

正确答案：E。儿童癔症